龈沟底与牙槽嵴顶之间的距离（生物学宽度）一般为
A. 1～2mm
B. ＞2mm
C. 2mm
D. 3～4mm
E. 5mm以上

正确答案：C。2mm

解析：正常情况下，从龈沟底到牙槽嵴顶的距离是恒定的，该距离称为生物学宽度，包括结合上皮和牙槽嵴顶冠方附着于根面的结缔组织，宽度一般为2mm左右。掌握“慢性牙周炎的病因，表现诊断及预后”知识点。